男，25岁，外伤输血治疗1小时，出现寒战，高热，心悸，气短，酱油色尿，尿隐血（+++），尿红细胞（-），发生上诉临床症状的主要免疫学基础是
A. 中性粒细胞吞噬导致红细胞破坏
B. 补体激活导致红细胞溶解
C. NK细胞裂解红细胞
D. CTL细胞杀伤红细胞
E. 巨噬细胞吞噬导致红细胞破坏

正确答案：B。补体激活导致红细胞溶解

解析：补体参与红细胞溶解作用：与红细胞抗原结合后的自身抗体和补体，通过传统补体激活途径C1a，使被激活后产生的补体(C3b、C5b等)插入红细胞膜内，使红细胞膜产生内外相通的水溶性道，造成电解质的逆流和水分渗入而致红细胞肿胀溶解（B对）。